肝圆韧带位于
A. 左纵沟前部
B. 左纵沟后部
C. 右纵沟前部
D. 右纵沟后部
E. 横沟

正确答案：A。左纵沟前部

解析：肝圆韧带位于肝脏面左纵沟前部(A对)。